男婴，3个月。高热伴频繁呕吐2天，嗜睡1天，惊厥2次。查体：精神差，双眼凝视，前囟隆起，脑膜刺激征阴性。实验室检查：血WBC15.0×10⁹/L，N0.88，L0.12。最可能的诊断是
A. 结核性脑膜炎
B. 化脓性脑膜炎
C. 热性惊厥
D. 病毒性脑炎
E. 中毒性脑病

正确答案：B。化脓性脑膜炎

解析：患婴3个月，急性起病，高热伴频繁呕吐、前囟隆起（提示颅内压增高），嗜睡、双眼凝视、精神差，实验室检查血WBC15.0×10⁹/L（正常值4.0～10.0×10⁹/L），N0.88（正常值0.5～0.7），L0.12（正常值0.2～0.4）中性粒细胞升高为主，应考虑化脓性脑膜炎（B对），脑膜刺激征阴性考虑与婴儿肌肉不发达，肌力弱和反应低下有关。结核性脑膜炎（A错）呈亚急性起病，不规则发热1～2周后才出现脑膜刺激征、惊厥或意识障碍等表现，有结核接触史、PPD阳性或肺部等其他部位结核病灶者支持结核性脑膜炎的诊断。